地方性氟病
A. 经食物链传递而富集最终影响人体健康的是
B. 胚胎期和婴儿发育早期机体严重碘缺乏可引起
C. 污水灌溉农田使农作物受污染而危害人体健康的是
D. 引起居民以斑釉齿和骨骼损害为特征的疾病是
E. 以皮肤损害为显著特点的生物地球化学性疾病为

正确答案：D。引起居民以斑釉齿和骨骼损害为特征的疾病是

解析：本题考查地方性氟病。引起居民以斑釉齿和骨骼损害为特征的疾病是（D对ABCE错）地方性氟病。地方性氟病是由于一定地区的环境中氟元素过多，而致生活在该环境中的居民经饮水、食物和空气等途径长期摄入过量氟所引起的以氟骨症和氟斑牙为主要特征的一种慢性全身性疾病。